治疗咳嗽迁延不愈或愈而复发，应首选
A. 止嗽散
B. 三拗汤
C. 桑杏汤
D. 泻白散
E. 华盖散

正确答案：A。止嗽散

解析：咳嗽迁延不愈或愈而复发者，病程长，长期耗损阴血，致肺阴亏虚，需在疏风散寒，宣肺止咳的基础上再加润肺之品，用止嗽散。（A对）。三拗汤以宣肺散寒为主，治疗风寒闭肺证（B错）。风燥伤肺证，其中偏温燥者，治宜疏风清肺，润燥止咳，方选桑杏汤（C错）。咳嗽肝火犯肺证治宜清肺泻肝，顺其降火，方选黛蛤散和泻白散（D错）。华盖散功能宣肺解表，祛痰止咳，用于治疗系素体痰多而风寒袭肺者（E错）。